呼吸补泻法中的补法是
A. 呼气时进针,吸气时出针
B. 呼气时进针,吸气时提插
C. 呼气时进针,吸气时捻转
D. 呼气时提插,吸气时捻转
E. 呼气时出针,吸气时进针

正确答案：A。呼气时进针,吸气时出针

解析：本题主要考查呼吸补泻法。病人呼气时进针，吸气时出针是补法（A对）。吸气时进针，呼气时出针是泻法（E错）。